《进口药品注册证》的有效期为
A. 2年
B. 3年
C. 5年
D. 1年
E. 7年零8个月

正确答案：C。5年

解析：本题考查《进口药品注册证》的有效期。《进口药品注册证》的有效期为5年（C对）。药品注册证书有效期为5年，药品注册证书有效期内持有人应当持续保证上市药品的安全性、有效性和质量可控性，并在有效期届满前6个月申请药品再注册。